成人内服麝香的一日常用量是
A. 0.01～0.03g
B. 0.03～0.1g
C. 0.1～0.3g
D. 0.3～1g
E. 1～3g

正确答案：B。0.03～0.1g

解析：本题考查麝香的用法用量。成人内服麝香的一日常用量是0.03～0.1g（B对）。麝香【用法用量】内服：入丸散，0.03～0.1g，不入煎剂。外用：适量，调敷或敷贴。苏合香【用法用量】内服：入丸散，0.3～1g（D错），不入煎剂。